男，32岁。右大腿枪弹伤4小时。伤口已经在院外经过初步处理。查体：T37.8℃，P141次/分，R28次/分，BP72/43mmHg。面色苍白，呼吸急促。双肺呼吸音清晰，心律齐。腹软，无压痛。大腿中下1/3处对穿性伤口，已经用纱布覆盖包扎，无明显渗血。足背动脉搏动弱。若对该患者行清创术，以下措施不正确的是
A. 沿大腿纵轴切开探查，切除创缘皮肤1～2mm
B. 若有大血管损伤，尽量修补
C. 伤口内放置引流物
D. 伤口近端绕扎止血带
E. 若清创彻底，一期缝合伤口

正确答案：E。若清创彻底，一期缝合伤口

解析：患者右大腿遭受枪弹伤，为火器伤。虽然受伤时间仅为4小时，但治疗时清创后不宜一期缝合（E错，为本题正确答案），因为初期清创后，挫伤区和震荡区参差交错，不易判断。此时应彻底清创，开放伤口引流3～5天后，酌情延期缝合。清创时应注意伤口近端绕扎止血带以防进一步出血（D对），原伤口应沿大腿纵轴切开探查，切除创缘皮肤1～2mm（A对），若有大血管、神经、肌腱损伤，应尽量修补（B对），缝合后可在伤口内放置引流物（C对）。